能以RNA为模板催化合成与RNA互补的DNA（cDNA）的酶称为
A. DNA聚合酶Ⅰ
B. DNA聚合酶Ⅱ
C. DNA聚合酶Ⅲ
D. RNA聚合酶
E. 反转录酶

正确答案：E。反转录酶

解析：能以RNA为模板催化合成与RNA互补的DNA（cDNA）的酶称为反转录酶（E对），又称逆转录酶。DNA聚合酶是以DNA为模板催化合成互补的DNA的酶，DNA聚合酶Ⅰ（A错）、DNA聚合酶Ⅱ（B错）、DNA聚合酶Ⅲ（C错）是原核生物DNA聚合酶的三个分型。RNA聚合酶（D错）是以DNA为模板催化合成互补的RNA链。